木通的功效是
A. 利水通淋，解暑
B. 利水通淋，敛疮
C. 利水通淋，消肿
D. 利水通淋，润肠
E. 利水通淋，下乳

正确答案：E。利水通淋，下乳

解析：本题考查的是木通的功效。木通的功效是利水通淋，下乳（E对）。木通：【功效】利水通淋，泄热，通经下乳。滑石：【功效】利尿通淋，清解暑热（A错）；外用清热收湿敛疮（B错）。连钱草：【功效】利湿通淋，清热解毒，散瘀消肿（C错）。冬葵子：【功效】利水通淋，下乳，润肠（D错）通便。